女，40岁。2天前体检超声提示胆囊内3cm强回声团，后伴声影，胆囊壁厚6mm平素无不适。糖尿病病史5年，目前血糖控制良好。无腹部手术史。其他检查未见异常，最适合患者的治疗方案是
A. 腹腔镜胆囊切除术
B. 保守治疗
C. ERCP取石
D. 开腹胆囊切除术
E. 胆囊造瘘术

正确答案：A。腹腔镜胆囊切除术

解析：患者女，40岁（胆囊结石高发年龄）。体检超声提示胆囊内3cm（直径≥2～3cm）强回声团，后伴声影，胆囊壁厚6mm（正常值为1～3mm，＞3mm为胆囊壁增厚，即伴有慢性胆囊炎），平素无不适。根据患者的实验室检查、临床表现及病史判断该患者有无症状胆囊结石（P439）。临床对于无症状胆囊结石作观察和随诊，但对于一些情况考虑手术治疗：①结石数量多及结石直径≥2～3cm；②胆囊壁钙化或瓷性胆囊；③伴有胆囊息肉≥1cm；④胆囊壁增厚（＞3mm）即伴有慢性胆囊炎。该患者符合①④两条，应行胆囊切除术（B错），临床常用具有损伤小、恢复快、疼痛轻、瘢痕不易发现等优点的腹腔镜胆囊切除术（A对D错）。ERCP取石（P434）（C错）一般用于肝外胆管及胆总管结石等疾病。胆囊造瘘术（P332）（E错）一般用于胆囊炎症重或全身耐受力极差的胆石症病人以达到引流胆汁、降低胆压，为后行手术打下基础的目的。